患儿经常遗尿，可达1夜数次，小便清长，面色苍白，肢凉怕冷，腰腿酸软，舌质淡。治疗应首选
A. 大补元煎
B. 菟丝子散
C. 补中益气汤
D. 十全大补汤
E. 金匮肾气丸

正确答案：B。菟丝子散

解析：患者遗尿日久，兼见虚寒诸症。肾气虚弱，命火不足，下元虚寒，不能约束水道而致小便清长，频频尿床。命火不足，故见面色苍白，肢凉怕冷；肾气虚弱，腰为肾府，故见腰腿酸软；舌象也符合肾气不足证，当用菟丝子散温补肾阳，固涩膀胱（B对）。大补元煎功可益气养血，滋补肝肾，但少固精缩尿之品（A错）。补中益气汤功可补益中气，合缩泉丸可治遗尿之肺脾气虚证（C错）。十全大补汤功可补益气血，但却无补肾缩尿之功（D错）。金匮肾气丸功可温补肾阳，但无固涩膀胱之功（E错）。